在境内销售香港生产的中成药，其注册证证号的格式应为
A. ZC+四位年号+四位顺序号
B. SC+四位年号+四位顺序号
C. S+四位年号+四位顺序号
D. BH+四位年号+四位顺序号
E. 国药准字J+四位年号+四位顺序号

正确答案：A。ZC+四位年号+四位顺序号

解析：本题考查的是药品批准文号的格式。在境内销售香港生产的中成药，其注册证证号的格式应为ZC+四位年号+四位顺序号（A对）。药品注册证书载明的药品批准文号的格式：①境内生产药品：国药准字H（Z、S）+四位年号+四位顺序号（C错）；②中国香港、澳门和台湾地区生产药品：国药准字H（Z、S）C+四位年号+四位顺序号（B错）；③境外生产药品：国药准字H（Z、S）J+四位年号+四位顺序号（D错）。其中，H代表化学药，Z代表中药，S代表生物制品。药品批准文号，不因上市后的注册事项的变更而改变。